原牙髓正常或牙髓炎未累及根尖者，根充后桩核冠开始的最早时间是
A. 3天
B. 5天
C. 1周
D. 2周
E. 3周

正确答案：A。3天

解析：本题考查牙体缺损修复体固位及适应、禁忌证。原牙髓正常或牙髓炎未累及根尖者，根充后桩核冠开始的最早时间是3天（A对）。根管充填后选择桩核冠修复的时间参考治疗情况和全身状况而定。一般完善的根管治疗后，观察1～2周，无临床症状后可以开始修复；原牙髓正常或牙髓炎未累及根尖者，观察时间可短，根管治疗3天后无症状，可开始修复；有瘘管的患牙需在治疗愈合后进行修复；有根尖周炎的患牙，一般需在根管治疗后观察1周以上，没有临床症状，进行修复；如果根尖病变较广泛者，需在治疗后较长时间观察，待根尖病变明显缩小形成骨硬板后才能修复。